对螺旋体作用最强的药物是
A. 硝苯吡啶
B. 替硝唑
C. 二甲胺四环素
D. 青霉素
E. 罗红霉素

正确答案：C。二甲胺四环素

解析：本题考查对螺旋体作用最强的药物。螺旋体对四环素、青霉素、红霉素都敏感，但是米诺环素（即二甲胺四环素）（C对）作用最强，临床多用。硝苯吡啶（A错）为钙拮抗剂，可抑制心肌和血管平滑肌细胞Ca²⁺内流，能松弛血管平滑肌，使外周血管阻力降低，血压下降，心肌耗氧量降低，同时能扩张冠状动脉，缓解冠脉痉挛，并能增加冠脉流量，增加心肌供氧量；对心脏能使心收缩力减弱，耗氧量降低。对Aa（厌氧菌）具有较强抑制作用的药物是替硝唑（B错）。青霉素（D错）主要用于治疗敏感的G+球菌和杆菌、G-球菌及螺旋体所致感染。罗红霉素（E错）是新一代大环内酯类抗生素，主要作用于革兰氏阳性菌、厌氧菌、衣原体和支原体等；其体外抗菌作用与红霉素相类似，体内抗菌作用比红霉素强1～4倍。